医德规范的具体表现形式应除外的是
A. 宣言
B. 誓词
C. 指南
D. 守则
E. 法规

正确答案：C。指南